抗过敏药物特非那定因可引发致死性尖端扭转型室性心动过速，导致药源性心律失常而撤市，其主要原因是
A. 药物结构中含有致心脏毒性的基团
B. 药物抑制心肌快速延迟整流钾离子通道(hERG）
C. 药物与非治疗部位靶标结合
D. 药物抑制心肌钠离子通道
E. 药物在体内代谢产生具有心脏毒性的醌类代谢物

正确答案：B。药物抑制心肌快速延迟整流钾离子通道(hERG）

解析：本题考查特非那定。特非那定因抑制心肌快速延迟整流钾离子通道(hERG）（B对）引起Q-T间期延长甚至引发致死性尖端扭转型室性心动过速，导致药源性心律失常而撤市。药物与非治疗部位靶标结合（C错）产生副作用的例子是经典的抗精神病药物产生的锥体外系副作用，如氯丙嗪、属于多巴胺受体阻断药。药物抑制心肌钠离子通道（D错）的药物有奎尼丁、普鲁卡因胺等。